在急性排斥反应中，主要的效应细胞是
A. CD2+Th1
B. CD4+Th1
C. CD6+Th1
D. CD8+Th1
E. CD10+Th1

正确答案：B。CD4+Th1

解析：在急性排斥反应中，T细胞尤其是CD4+Th1细胞是主要的效应细胞。激活的Th1细胞通过释放IFN-γ和IL-2等细胞因子发动针对移植物的Ⅳ型超敏反应，造成移植物的损伤。CD8+CTL也参与对同种异体移植物的急性排斥反应。掌握“移植免疫”知识点。